在中国，急性胰腺炎最常见的诱发因素是
A. 暴饮暴食
B. 酗酒
C. 胆道结石病
D. 胃肠炎
E. 甲状旁腺功能亢进

正确答案：A。暴饮暴食

解析：本题须注意区分诱因和病因。急性胰腺炎最常见的诱发因素是暴饮暴食（一版内科学P384）（A对）。暴饮暴食时，大量食糜涌入十二指肠，可刺激胰液和胆汁大量分泌，同时可引起十二指肠乳头水肿和Oddi括约肌痉挛。此时，胰液和胆汁因下行受限而返流入胰腺，诱发胰腺炎。酗酒（B错）是西方国家急性胰腺炎最常见病因。胆道结石病（C错）是国人急性胰腺炎最常见的病因。胃肠炎（D错）与急性胰腺炎相关性不大。甲状旁腺功能亢进（E错）所导致的高钙血症可使胰管钙化，促进胰酶提前激活诱发急性胰腺炎（九版内科学P429）。